可引起神经肌肉阻断作用的药物是
A. 链霉素
B. 羧苄青霉素
C. 头孢菌素
D. 林可霉素
E. 红霉素

正确答案：A。链霉素

解析：氨基糖苷类的不良反应-神经肌肉麻痹：见于大剂量腹膜内或胸膜内应用时，或静脉滴注速度过快时，也偶见于肌内注射给药。由于药物能与突触前膜钙结合部位结合，抑制乙酰胆碱释放，因而可阻断神经肌肉部位的传导，引起心肌抑制、血压下降、肢体瘫痪、甚至呼吸抑制（A对）。